小儿生理特点中，“纯阳”的“阳”，是指
A. 脏腑的生理功能
B. 肢体的功能活动
C. 精、血、津、液等物质
D. 生长发育的生机
E. 脏气清灵的特征

正确答案：D。生长发育的生机

解析：小儿生理特点为生机蓬勃、发育迅速，“纯阳”中“阳”指的就是这种生长发育的生机（D对）。脏腑的生理功能指吴鞠通的稚阴稚阳理论中的“阳”（A错）。肢体的功能活动无法概括小儿的生理特点（B错）。精、血、津、液等物质属有形之质属“阴”（C错）。脏气清灵的特征，指与成人相比，小儿的机体生机蓬勃，脏腑之气清灵，随拨随应，对各种治疗反应灵敏，并且小儿宿疾较少，病情相对单纯（E错）。